某女，35岁。入睡困难，甚则彻夜不眠，急躁易怒，头晕头胀，目赤耳鸣，口干而苦，便秘溲赤：舌红苔黄、脉弦而数，诊断为不寐，辨析其证候是
A. 心脾两虚
B. 心肾不交
C. 痰热扰心
D. 心胆气虚
E. 肝火扰心

正确答案：E。肝火扰心

解析：本题考查的是不寐的辨证论治。某女，35岁。入睡困难，甚则彻夜不眠，急躁易怒，头晕头胀，目赤耳鸣，口干而苦，便秘溲赤：舌红苔黄、脉弦而数，诊断为不寐，辨析其证候是肝火扰心（E对）。不寐是以经常不能获得正常睡眠为特征的疾病，主要表现为睡眠时间、深度的不足，轻者入睡困难，或寐而不酣，时寐时醒，或早醒，或醒后不能再寐，重则彻夜不寐。西医学中神经症，以及多种心脑血管疾病、贫血、肝病等疾病以失眠为主要表现者，可参考此内容辨证论治。（一）肝火扰心证：【症状】不寐多梦，甚则彻夜不眠，急躁易怒，伴头晕头胀，目赤耳鸣，口干而苦，不思饮食，便秘溲赤。舌红苔黄，脉弦而数。（二）痰热扰心证（C错）：【症状】心烦不寐，胸闷脘痞，泛恶嗳气，伴口苦，头重，目眩。舌质偏红，苔黄腻，脉滑数。（三）心脾两虚证（A错）：【症状】不易入睡，多梦易醒，心悸健忘，神疲食少，伴头晕目眩，四肢倦怠，腹胀便溏，面色少华。舌淡苔薄，脉细无力。（四）心肾不交证（B错）：【症状】心烦不寐，入睡困难，心悸多梦，伴头晕耳鸣，腰膝酸软，潮热盗汗，五心烦热，咽干少津，男子遗精，女子月经不调。舌红少苔，脉细数。（五）心胆气虚证（D错）：【症状】虚烦不眠，触事易惊，终日惕惕，胆怯心悸，伴气短自汗，倦怠乏力。舌淡，脉弦细。